新生儿寒冷损伤综合征的皮肤硬肿最早出现在
A. 小腿
B. 大腿
C. 躯干
D. 臀部
E. 面部

正确答案：A。小腿

解析：新生儿寒冷损伤综合征是由于寒冷和（或）多种疾病所致，皮肤硬肿为其主要临床表现之一。皮肤硬肿常呈对称性，发生顺序依次为：小腿（A对）－大腿外侧（B错）－整个下肢－臀部（D错）－面颊（E错）－上肢－全身（C错）。